提高宿主抵抗力的措施是
A. 降低牙尖高度和斜度
B. 去除不良修复体
C. 补充维生素和钙磷等营养
D. 治疗食物嵌塞
E. 去除充填悬突

正确答案：C。补充维生素和钙磷等营养

解析：全身因素关系到牙周组织对局部刺激因素的反应，影响着牙周组织破坏的严重程度和修复能力。所以需要积极治疗和控制与牙周病发生有关的全身性疾病之外，还要进行补充营养等全身支持治疗，以提高宿主的抵抗力。掌握“牙周病流行病学及分级预防”知识点。